急性肾衰竭时，可用何药与利尿剂配伍来增加尿量
A. 多巴胺
B. 麻黄碱
C. 去甲肾上腺素
D. 异丙肾上腺素
E. 肾上腺素

正确答案：A。多巴胺

解析：多巴胺临床应用：①休克：用于各种休克。滴注给药时必须补足血容量，同时需纠正酸中毒。②与利尿药联合应用于急性肾衰竭。掌握“多巴胺和异丙肾上腺素”知识点。